癫痫用药应遵循的原则是
A. 按类型用药、联合用药、早期用药、小量起始
B. 个体化治疗、尽量单药、早期用药、足量起始
C. 按类型用药、单药用药、早期用药、长期治疗
D. 个体化治疗、联合用药、早期用药、长期治疗
E. 按类型用药、尽量单药、个体化治疗、足量起始

正确答案：C。按类型用药、单药用药、早期用药、长期治疗

解析：癫痫患者的用药原则为：早期根据不同患者的发作状况及患者本人和家属意愿选择用药或不用药，一旦确诊，应尽早用药（早起用药），对于需要药物治疗的患者应根据癫痫发作的类型选用药物（按类型用药）。尽可能单药治疗、从小剂量开始，缓慢增量至可最大限度地控制癫痫发作且不良反应较轻。若单药治疗不理想，则可合理地进行联合治疗。使用抗癫痫药控制发作后必须坚持长期服药，除非出现严重的不良反应，否则不能随意增减药、换药或停药，以免诱发癫痫持续状态。综上，癫痫患者用药原则应为：按类型用药、单药用药、尽早用药、小量起始、长期治疗。故本题没有正确答案（ABCDE错）。